毛状白斑是什么疾病的主要临床表现
A. 带状疱疹
B. 梅毒
C. 艾滋病
D. 淋病
E. 尖锐湿疣

正确答案：C。艾滋病

解析：本题考查HIV感染的口腔表现。毛状白斑是艾滋病（C对）的主要临床表现，艾滋病即HIV感染。带状疱疹（A错）是由水痘-带状疱疹病毒（VZV）所引起的，以沿单侧周围神经分布的簇集性小水疱为特征，常伴有明显的神经痛。梅毒（B错）是由梅毒螺旋体引起的一种慢性、系统性的性传播疾病，分为早期梅毒和晚期梅毒。淋病（D错）是由淋病奈瑟菌所致的泌尿生殖系统感染，潜伏期短，传染性强。尖锐湿疣（E错）是由人乳头瘤病毒（HPV）感染引起的以疣状病变为主的性传播疾病。好发部位在外生殖器及肛门周围的皮肤黏膜湿润区。